曲池在五输穴中属
A. 井穴
B. 荥穴
C. 合穴
D. 经穴
E. 输穴

正确答案：C。合穴

解析：曲池穴为大肠经的合穴（C对）。手阳明大肠经井穴（A错）是商阳，荥穴（B错）是二间，输穴（E错）是三间，经穴（D错）是阳溪。